关于缓释、控释制剂的说法，错误的是
A. 缓释制剂给药后血药浓度较为平静
B. 渗透泵可以均匀地恒速释放药物
C. 药效作用剧烈的药物宜制成控释制剂
D. 肌内注射药物的混悬液均有缓释作用
E. 胃漂浮片可提高药物在十二指肠的疗效

正确答案：C。药效作用剧烈的药物宜制成控释制剂

解析：本题考查的是缓释、控释制剂的特点。药效剧烈的药物不宜制成缓释、控释制剂的药物（C错，为本题正确答案）。缓释、控释制剂的特点：与普通制剂比较，缓释、控释制剂具有以下特点。①药物治疗作用持久、毒副作用小、用药次数显著减少。②药物可缓慢地释放进入体内，血药浓度的“峰谷”波动小（A对），可避免超过治疗血药浓度范围的毒副作用，又能保持在有效浓度治疗范围（治疗窗）之内以维持疗效。不宜制成缓释、控释制剂的药物：（1）生物半衰期（t1/2）很短（小于1小时）或很长（大于24小时）的药物。（2）单服剂量很大（大于1g）的药物。（3）药效剧烈、溶解度小、吸收无规律、吸收差或吸收易受影响的药物。（4）需在肠道中特定部位主动吸收的药物。渗透泵式控释制剂：系指利用渗透压原理制成的控释制剂，能均匀恒速地释放药物（B对）。注射用缓释制剂：系将药物制成油溶液型或混悬液型注射剂。注入人体后油中药物或混悬药物粒子，向注射部位体液中分配或溶解的延缓作用而达到缓释目的（D对）。胃滞留型缓释、控释制剂：系指通过黏附、漂浮或膨胀等作用定位（滞留）于胃中释放药物的口服定位释药系统。又称胃内滞留给药系统。可以提高主要在胃内及十二指肠部位吸收的药物的生物利用度（E对）；提高药物在胃内及十二指肠部位的局部治疗效果。